根据执业药师注册管理相关规定，关于执业药师注册许可的说法，正确的有
A. 执业药师注册允许跨地域多点执业
B. 《执业药师注册证》有效期为三年
C. 执业药师注册后，执业时应悬挂《执业药师注册证》明示
D. 执业药师申请再次注册，必按规定完成继续教育

正确答案：C、D。执业药师注册后，执业时应悬挂《执业药师注册证》明示；执业药师申请再次注册，必按规定完成继续教育

解析：本题考查的是执业药师注册管理的相关规定。根据执业药师注册管理相关规定，关于执业药师注册许可的说法，正确的有执业药师注册后，执业时应悬挂《执业药师注册证》明示（C对）、执业药师申请再次注册，必按规定完成继续教育（D对）。执业药师继续教育：为了规范继续教育活动，保障专业技术人员权益，人力资源和社会保障部于2015年8月13日发布《专业技术人员继续教育规定》（人力资源和社会保障部令第25号），与12号文配套的执业药师继续教育管理规定仍在研究修订中。根据《专业技术人员继续教育规定》和12号文，执业药师（包括取得《执业药师职业资格证书》的人员）应当按照国家专业技术人员继续教育的有关规定接受继续教育，更新专业知识，提高业务水平。接受继续教育是执业药师的义务和权利，执业药师必须按规定积极参加继续教育，完善知识结构、增强创新能力、提高专业水平。用人单位应当保障执业药师参加继续教育的权利。执业药师的继续教育学分，应由继续教育管理机构及时记入全国执业药师注册管理信息系统。药品零售企业应当在营业场所的显著位置悬挂药品经营许可证、营业执照、执业药师注册证等。营业人员应当佩戴有照片、姓名、岗位等内容的工作牌，执业药师和药学技术人员的工作牌还应当标明执业资格或者药学专业技术职称，在岗执业的执业药师应当挂牌明示。执业药师应当按照执业类别、执业单位、执业范围进行注册和执业（A错）。执业药师注册有效期为五年（B错）。需要延续的，应当在有效期届满三十日前，向所在地注册管理机构提出延续注册申请。